下列组织来自上皮根鞘、遇到刺激可以形成牙源性囊肿或牙源性肿瘤的是
A. 结合上皮
B. 釉小皮
C. 马拉瑟上皮剩余
D. Serre上皮剩余
E. 上皮隔

正确答案：C。马拉瑟上皮剩余

解析：牙本质形成后，断裂的上皮根鞘可遗留在发育中的牙周膜，称为上皮剩余，也成马拉瑟上皮剩余。此上皮剩余遇刺激可形成牙源性囊肿或牙源性肿瘤。掌握“牙体、牙周组织的形成”知识点。